患者男性，20岁，骑自行车转弯时不慎与对面行驶过来的小汽车发生碰撞，颏部着地。检查：神清，颏部皮肤裂开，渗血，耳前区肿胀、有压痛，张口度1.5cm，后牙早接触，前牙开（牙合），咬合关系紊乱。其最佳治疗方法是
A. 颏部清创
B. 手术切开复位固定
C. （牙合）垫+颅颌弹力绷带+颌间结扎
D. 不处理，观察随访
E. 下颌单颌结扎

正确答案：B。手术切开复位固定

解析：本题考查牙槽突骨折、颌骨骨折。若单纯颏部骨折不会造成后牙早接触、前牙开（牙合），而咬合关系错乱的颞下颌关节骨折除了手术切开复位并固定（B对），都不能达到理想的治疗效果。